某饭店职工健康体检时发现一名职工为甲型肝炎患者。对该患者所采取的措施为
A. 接种乙肝疫苗
B. 接种甲肝疫苗
C. 隔离治疗
D. 仍可继续工作，但要接受药物治疗
E. 痊愈后也不能在饮食行业工作

正确答案：C。隔离治疗